关于基因治疗的叙述，正确的是
A. 输入干细胞
B. 注射多肽药物
C. 注射细胞因子
D. 注射动物提取的核酸
E. 输入导入了相应外源基因的细胞

正确答案：E。输入导入了相应外源基因的细胞